新月体肾炎Ⅲ型患者血液免疫学检查最常出现的异常是
A. 抗中性粒细胞胞浆抗体阳性
B. 单克隆免疫球蛋白增高
C. 抗肾小球基底膜抗体阳性
D. 循环免疫复合物阳性
E. 冷球蛋白阳性

正确答案：A。抗中性粒细胞胞浆抗体阳性

解析：新月体肾炎即急进性肾小球肾炎（RPGN），Ⅲ型（免疫反应缺乏性）新月体肾炎最常见的血清学指标变化是抗中性粒细胞胞浆抗体（ANCA）阳性（A对）。单克隆免疫球蛋白（B错）升高见于单克隆免疫球蛋白血症（P592）。抗肾小球基底膜（GBM）抗体阳性（C错）是Ⅰ型（抗GBM抗体性）新月体肾炎常见的血清学指标变化（P467）。循环免疫复合物阳性（D错）及冷球蛋白阳性（E错）是Ⅱ型（免疫复合物性）新月体肾炎的血清学指标变化（P467）。